药物结构中含芳香杂环结构的H₂受体拮抗剂有
A. 尼扎替丁
B. 法莫替丁
C. 罗沙替丁
D. 西咪替丁
E. 雷尼替丁

正确答案：A、B、C、D、E。尼扎替丁；法莫替丁；罗沙替丁；西咪替丁；雷尼替丁

解析：本题考查组胺H₂受体阻断剂类抗溃疡药。尼扎替丁（A对）、法莫替丁（B对）、罗沙替丁（C对）、西咪替丁（D对）、雷尼替丁（E对）均为组胺H₂受体阻断剂，该类药物均有两个药效基团，具有显性的芳环结构和平面的极性基团。雷尼替丁含有呋喃核；西咪替丁含有咪唑五元环；法莫替丁和尼扎替丁含有噻唑环；罗沙替丁含有哌啶甲苯结构。